根据腧穴主治规律，足三阳经腧穴主治相同的病证是
A. 胃肠病
B. 咽喉病
C. 头面病
D. 神志病
E. 耳病

正确答案：D。神志病

解析：足三阳经包括足阳明胃经、足少阳胆经和足太阳膀胱经。足少阳和足太阳同治眼病，三经同治热病、神志病（D对）。胃经治疗胃肠病、咽喉病（AB错）；胆经治疗耳病（E错）；三阳经治头病有部位之分，胃经治疗前头病、胆经治侧头病、膀胱经治后头病，亦不全能治疗面部疾病（C错）。